六味地黄丸适用于治疗糖尿病的证型是
A. 胃热炽盛
B. 气阴两虚
C. 肺热津伤
D. 阴阳两虚
E. 肾阴亏虚

正确答案：E。肾阴亏虚

解析：六味地黄丸可滋阴固肾，故适用于糖尿病肾阴亏虚证（E对）。胃热炽盛证（A错）可清胃泻火，养阴增液，方药当选用玉女煎加减；气阴两虚证（B错）治法为益气健脾，生津止渴，方药当选用七味白术散加减；肺热津伤证（C错）治法为清热润肺，生津止渴，方药选用消渴方加减；阴阳两虚证（D错）治法为滋阴温阳，补肾固摄，方药当选用金匮肾气丸加减。